中国药典对普通片剂的崩解时限的规定是
A. 15分钟
B. 30分钟
C. 45分钟
D. 1小时
E. 1小时30分钟

正确答案：A。15分钟

解析：本题考查片剂的崩解时限。普通片剂的崩解时限是15分钟（A对）。